女，22岁，阵发性心悸，头痛、大汗3月余，多在体位变化、情绪激动时发作，体重减轻约5kg，发作时面色苍白，多汗，血压最高时达220/110mmHg，心率100次/分，静注酚妥拉明后1分钟血压可降至150/100mmHg，肾上腺CT显示右肾上腺有一直径大约5cm类球形占位，最可能的诊断是
A. 肾病综合征
B. 嗜铬细胞瘤
C. 库欣综合征
D. 甲状腺功能亢进
E. 原发性醛固酮增多症

正确答案：B。嗜铬细胞瘤

解析：女，22岁，阵发性心悸，头痛、大汗（嗜铬细胞瘤高血压发作时所伴随的三联征且阵发性高血压型为其特征性表现）3月余，多在体位变化、情绪激动时发作（嗜铬细胞瘤的诱发因素），体重减轻约5kg（嗜铬细胞瘤患者基础基础代谢增高，代谢亢进时能引起消瘦），发作时面色苍白，多汗，血压最高时达220/110mmHg（嗜铬细胞瘤高血压发作时血压骤升，收缩压可达200～300mmHg，舒张压可达130～180mmHg），心率100次/分，静注酚妥拉明（嗜铬细胞瘤常用α受体拮抗药）后1分钟血压可降至150/100mmHg，肾上腺CT显示右肾上腺有一直径大约5cm类球形占位（肾上腺CT支持嗜铬细胞瘤诊断）。综合该患者的病史、临床表现、影像学检查等，该患者诊断考虑为嗜铬细胞瘤（B对）。当出现大量蛋白尿（＞3.5g/d）、低蛋白血症、水肿、高脂血症时考虑肾病综合征（A错）。库欣综合征（C错）（P699-P670）典型表现常有向心性肥胖、满月脸、多血质外貌，糖皮质激素分泌异常，且不能被小剂量地塞米松所抑制。该患者虽有高代谢体征，但未有血清甲状腺激素水平增高及甲状腺肿大，所以不选甲状腺功能亢进（D错）。原发性醛固酮增多症表现为高血压低血钾，且血浆及尿醛固酮增高等（E错）。